下列哪个不是大消化腺
A. 腮腺
B. 舌腺
C. 下颌下腺
D. 肝
E. 胰

正确答案：B。舌腺

解析：大消化腺包括大唾液腺、肝（D对）和胰（E对），大唾液腺又包括腮腺（A对），下颌下腺（C对）以及舌下腺(B错，为本题正确答案)。